某菌痢患者已住院隔离，疾病预防控制中心于12小时内派人前往患者家，对患者的接触物品、餐具及周围环境进行彻底消毒，该措施属于
A. 终末消毒
B. 经常性消毒
C. 随时消毒
D. 预防性消毒
E. 化学消毒

正确答案：A。终末消毒

解析：本题考查终末消毒。终末消毒是当传染源痊愈、死亡或离开后对疫源地进行的彻底消毒，从而清除传染源所播散在外界环境中的病原体。本题中菌痢患者已住院隔离，疾控中心对患者的接触物品、餐具及周围环境进行彻底消毒属于终末消毒（A对BCDE错）。